根尖和根中1/3根折的转归正确的是
A. 两断端由钙化组织联合
B. 结缔组织将各段分开，断面上有牙骨质生长，但不出现联合
C. 未联合的各段由结缔组织和骨桥分开
D. 断端由慢性炎症组织分开
E. 以上均可出现

正确答案：E。以上均可出现

解析：本题考查根尖和根中1/3根折的转归。根尖和根中1/3折断的转归有：两断端由钙化组织联合（A对）；结缔组织将各段分开，断面上有牙骨质生长，但不出现联合（B对）；未联合的各段由结缔组织和骨桥分开（C对）；断端由慢性炎症组织分开（D对）。（ABCD均对，故E为正确答案）。